三九胃泰颗粒除消炎止痛外，又能
A. 补脾益气
B. 行气化湿
C. 疏肝解郁
D. 补气生津
E. 理气健胃

正确答案：E。理气健胃

解析：本题考查的是三九胃泰颗粒的功效。三九胃泰颗粒除消炎止痛外，又能理气健胃（E对）。三九胃泰颗粒功效：清热燥湿，行气活血，柔肝止痛，消炎止痛，理气健胃。六君子丸【功能】补脾益气（A错），燥湿化痰。木香顺气丸【功能】行气化湿（B错），健脾和胃。解郁安神颗粒【功能】疏肝解郁（C错），安神定志。清暑益气丸【功能】祛暑利湿，补气生津（D错）。